（牙合）面洞深应为
A. 1mm
B. 1～1.5mm
C. 1.5～2mm
D. 2.5mm
E. 3mm

正确答案：C。1.5～2mm

解析：本题考查（牙合）面洞深。一般（牙合）面洞深应为1.5～2mm（C对），过浅则充填体厚度过薄，没有足够的抗力，易在行使功能时折裂或脱落，过深则可能磨除过多健康组织甚至造成穿髓。邻面洞的深度应为1～1.5mm（B错）。